九味羌活汤的组成药物中含有
A. 白芍药
B. 山茱萸
C. 生地
D. 麦门冬
E. 枸杞子

正确答案：C。生地

解析：九味羌活汤的组成药物中含有羌活、防风、苍术、细辛、川芎、香白芷、生地（C对）、黄芩、甘草；主治外感风寒湿邪，内有郁热证（九味羌活用防风，细辛苍芷与川芎，黄芩生地同甘草，三阳解表宜变通）。